上消化道出血患者出现呕血时，提示胃内贮积的血量是
A. 5～20mL以上
B. 30～40mL以上
C. 50～70mL以上
D. 80～100mL以上
E. 250～300mL以上

正确答案：E。250～300mL以上

解析：据研究，成人每日消化道出血＞5mL即可出现粪便隐血试验阳性（A错），每日出血量50～100mL可出现黑便（CD错），胃内蓄积血量在250～300mL可引起呕血（E对）。